舌疳的病机是
A. 脾病及心
B. 脾病及肺
C. 脾病及肝
D. 阳虚水泛
E. 脾病及肾

正确答案：A。脾病及心

解析：小儿疳证失治误治，导致脾胃虚衰加重，生化乏源，气血亏耗，诸脏失养，累及肺、心、脾、肾四脏，出现各种兼证，其中脾病及心，心阴受损，导致心火亢盛，心火上炎，而心开窍于舌，故见口舌生疮，称为口疳（A对）。脾病及肺，肺阴受损，阴虚生内热，出现咳喘、潮热者，称为肺疳（B错）。脾病及肝，肝之阴血不足，不能上荣头目，目失所养，则视物不清，夜盲目翳，称为眼疳，也称肝疳（C错）。脾虚日重，阴津大亏，阴损及阳，阳虚水泛，全身浮肿，称为疳肿胀（D错）。脾病及肾，肾之阴精不足，阴损及阳，阴阳两亏，骨失所养，久则骨骼畸形，称为骨疳，也称肾疳（E错）。